引起逆行性牙髓炎的原因是
A. 严重的牙龈炎
B. 伴有深牙周袋的牙周炎
C. 严重的牙外伤
D. 过深的楔状缺损
E. 曾做过牙髓治疗

正确答案：B。伴有深牙周袋的牙周炎

解析：本题考查引起逆行性牙髓炎的原因。引起逆行性牙髓炎的原因是伴有深牙周袋的牙周炎（B对），袋内的细菌及毒素通过根尖孔或侧、副根管逆行进入牙髓，引起根部牙髓的慢性炎症，也可急性发作。严重的牙龈炎（A错）也无牙周袋的形成，故细菌无进入牙髓的途径，不会引起牙髓炎症。严重的牙外伤（C错）、过深的楔状缺损（D错）都可能发生牙髓炎症，但不称为逆行性牙髓炎。曾做过牙髓治疗（E错）的牙发生的牙髓炎称为残髓炎。